伴有支气管哮喘的高血压患者禁用的药物是
A. 普萘洛尔
B. 哌唑嗪
C. 甲基多巴
D. 氨氯地平
E. 尼群地平

正确答案：A。普萘洛尔

解析：本题考查普萘洛尔。伴有支气管哮喘的高血压患者禁用的药物是普萘洛尔（A对）。普萘洛尔禁忌证：①支气管哮喘。②心源性休克。③心脏传导阻滞（二至三度房室传导阻滞）。④重度或急性心力衰竭。⑤窦性心动过缓。哌唑嗪（B错）禁用于对哌唑嗪过敏者。甲基多巴（C错）禁用于急性肝脏疾患和嗜铬细胞瘤患者。氨氯地平（D错）禁用于对二氢吡啶类钙拮抗剂过敏者。严重低血压，主动脉瓣狭窄患者。尼群地平（E错）禁忌证：1.孕妇及哺乳妇女禁用。2.对尼群地平或其他钙通道阻滞药过敏。3.严重主动脉瓣狭窄。